六味地黄丸的功能是
A. 滋阴降火
B. 滋阴补气
C. 滋阴养心
D. 滋阴补肾
E. 滋阴养肺

正确答案：D。滋阴补肾

解析：本题考查的是六味地黄丸的功能。六味地黄丸的功能是滋阴补肾（D对）。六味地黄丸：【功能】滋阴补肾。大补阴丸：【功能】滋阴降火（A错）。麦味地黄丸：【功能】滋肾养肺（E错）。功能为滋阴补气（B错）与滋阴养心（C错）的中成药，2022年考试指南未明确说明。